可导致心脏停搏，切忌直接静脉推注的药品是
A. 尼可刹米
B. 洛贝林
C. 甲氧氯普胺
D. 呋塞米
E. 氯化钾

正确答案：E。氯化钾

解析：本题考查给药方式。氯化钾（E对）注射液切忌直接静脉注射，应于临用前稀释，否则不仅引起剧痛，且致心脏停搏。尼可刹米（A错）可用静脉注射。洛贝林（B错）是一种呼吸兴奋剂，可采用静脉注射或者皮下、肌肉注射。甲氧氯普胺注射液（C错）是一种镇吐药。呋塞米（D错）为利尿药，可静脉注射。